女性，44岁，患甲状腺功能亢进10余年。现瘿肿质软，目涩目突，手颤，心悸少寐，腰膝酸软，头晕耳鸣，舌质红，苔少，脉细数。治宜
A. 天王补心丹
B. 海藻玉壶汤
C. 丹栀逍遥散合消瘰丸
D. 四海舒郁丸
E. 六味地黄汤合黄连阿胶汤

正确答案：E。六味地黄汤合黄连阿胶汤

解析：本题患者瘿肿质软，目涩目突，手颤，心悸少寐，腰膝酸软，头晕耳鸣，舌质红，苔少，脉细数，为阴虚火旺当用六味地黄汤合黄连阿胶汤（E对）。心肝阴虚当用天王补心丹（A错）。痰结血瘀当用海藻玉壶汤（B错）。肝火旺盛当用丹栀逍遥散合消瘰丸（C错）。气郁痰阻当用四海舒郁丸（D错）。